血瘀证可见的症状是
A. 刺痛拒按，固定不移，舌暗，脉涩
B. 气短疲乏，脘腹坠胀，舌淡，脉弱
C. 胸胁胀闷窜痛，时轻时重，脉
D. 面色淡白，口唇爪甲色淡，舌淡，脉细
E. 少气懒言，疲乏无力，自汗，舌淡，脉虚

正确答案：A。刺痛拒按，固定不移，舌暗，脉涩

解析：血瘀证的病机为瘀血内积，气血运行受阻，不通则痛，故刺痛拒按，固定不移，血行瘀滞，则血色变紫变黑，脉络瘀阻，故见舌暗，脉涩（A对）。气短疲乏，脘腹坠胀，舌淡，脉弱是气陷证的临床表现（B错）。胸胁胀闷窜通，时轻时重，脉弦是气滞证的临床表现（C错）。面色淡白，口唇爪甲色淡，舌淡，脉细是血虚证的临床表现（D错）。少气懒言，疲乏无力，自汗，舌淡，脉虚是气虚证的临床表现（E错）。